下唇、口角、舌尖出现麻木表示何种阻滞麻醉显效
A. 下牙槽神经阻滞麻醉
B. 舌神经阻滞麻醉
C. 颊长神经阻滞麻醉
D. 下颌神经阻滞麻醉
E. 颏神经、切牙神经阻滞麻醉

正确答案：D。下颌神经阻滞麻醉

解析：本题考查下颌神经阻滞麻醉。下颌神经阻滞麻醉（D对）是用于麻醉同侧下颌牙、舌前2/3、口底、下颌骨及颌周组织、升颌肌群、颞部皮肤及颊部皮肤黏膜等。可使下唇、口角、舌尖出现麻木、肿胀和烧灼感。下牙槽神经阻滞麻醉（A错）是用于麻醉同侧下颌、下颌牙、牙周膜、前磨牙至中切牙唇（颊）牙龈、黏骨膜及下唇的。舌神经阻滞麻醉（B错）是用于麻醉同侧下颌舌侧牙龈、黏骨膜，口底黏膜及舌前面2/3部分。颊长神经（C错）是用于麻醉同侧下颌磨牙的颊侧牙龈、黏骨膜、颊部黏膜、肌和皮肤的。颏神经分布到下唇黏膜、皮肤和颏部；切牙神经（E错）分布到第一前磨牙、尖牙和切牙的牙髓、牙槽突和牙周膜。